男，35岁。发热、呕吐、腹痛、腹泻半天。查体：T39.2℃，BP120/70mmHg，腹软，左下腹压痛（+），反跳痛（-），实验室检查：血WBC12×10⁹/L，N0.85，L0.15。粪镜检WBC40/HP，RBC2/HP。最可能的诊断是
A. 急性阑尾炎
B. 溃疡性结肠炎
C. 霍乱
D. 急性细菌性痢疾
E. 急性阿米巴痢疾

正确答案：D。急性细菌性痢疾

解析：患者中青年男性，查体T39.2℃（高热），腹泻半天，左下腹压痛（+）（细菌性痢疾典型临床表现），实验室检查中血WBC12×10⁹/L（正常范围4~10×10⁹/L），N0.85（正常50%~70%），粪检WBC40/HP及RBC2/HP。以上临床表现，实验室检查均提示最可能的诊断是急性细菌性痢疾（D对）。急性阑尾炎（A错）的典型表现为腹痛发作于上腹，逐渐移向脐部，数小时后转移并局限在右下腹。溃疡性结肠炎（B错）以反复发作的腹泻、粘液脓血便及腹痛为主要症状，可伴肠外表现；起病多亚急性，病程迁延。霍乱（C错）起病急，腹泻常为无痛性剧烈腹泻，不伴有里急后重，呕吐发生在腹泻之后，多不伴恶心，呈喷射性（P174）。急性阿米巴痢疾（E错）多不发热，腹痛轻，无里急后重，多为右下腹压痛，便量多，暗红色果酱样便，镜检可找到溶组织内阿米巴滋养体（P261）。